某男，47岁，患脾胃气滞之脘腹胀痛，兼食少便溏，治当行气止痛、健脾消食，宜选用的药是
A. 梅花
B. 甘松
C. 玫瑰花
D. 木香
E. 化橘红

正确答案：D。木香

解析：本题考查的是木香的功效。患脾胃气滞之脘腹胀痛，兼食少便溏，治当行气止痛、健脾消食，宜选用的药是木香（D对）。木香：【功效】行气止痛，健脾消食。梅花（A错）：【功效】疏肝解郁，和中，化痰。甘松（B错）：【功效】行气止痛，开郁醒脾。玫瑰花（C错）：【功效】行气解郁，活血止痛。化橘红（E错）：【功效】理气宽中，燥湿化痰，消食。